下列腧穴中，治疗胎位不正的是
A. 太冲
B. 合谷
C. 大敦
D. 三阴交
E. 至阴

正确答案：E。至阴

解析：至阴位于足太阳膀胱经上，在足趾，足小趾末节外侧，趾甲根角侧后方0.1寸，可矫正胎位不正（E对），矫正胎位不正宜用灸法。